患儿，10岁。发热，耳下腮部漫肿疼痛。除内服药外，宜配合使用的外治法是
A. 附子末醋调作饼贴足心
B. 吴茱萸研末醋调敷足心
C. 白芥子末、面粉水调敷腮部
D. 青黛散醋调敷腮部
E. 麻黄水煎，加黄酒，熏洗腮部

正确答案：D。青黛散醋调敷腮部

解析：患儿以发热，耳下腮部漫肿疼痛为特征，当属流行性腮腺炎，其主要病机为邪毒壅阻足少阳经脉，与气血相博，凝滞于耳下腮部，青黛散可清热解毒，消肿止痛（D对）。附子末性大热，温阳散寒，不适宜阳证（A错）。吴茱萸调敷足心可引火归元，多用于治疗失眠及口腔溃疡（B错）。白芥子末辛辣多用于治疗哮喘、过敏性鼻炎性等疾病（C错）。麻黄性辛温，多用于风寒感冒（E错）。